眶下神经阻滞麻醉口外注射法进针的方向是
A. 下后外
B. 上后内
C. 上后外
D. 上外
E. 下后内

正确答案：C。上后外

解析：本题考查眶下神经阻滞麻醉-口外注射法。眶下神经阻滞麻醉口外注射法进针的方向是上后外（C对）。1.眶下神经阻滞麻醉口外注射法进针的方向是注射针与皮肤成45°角，向上后外进针约1.5cm，刺入眶下孔并注射麻药约1mL。2.上牙槽后神经阻滞麻醉的进针方向是注射针与上颌牙长轴成40°角，向上后内（B错）方刺入。